意志行动中善于控制自已的行动，约束自己言行的心理品质是意志的
A. 自觉性
B. 果断性
C. 坚韧性
D. 自制性
E. 独立性

正确答案：D。自制性